需同服维生素B₆
A. 乙胺丁醇
B. 利福平
C. 异烟肼
D. 对氨基水杨酸
E. 卡那霉素

正确答案：C。异烟肼